男性，50岁。既往乙型肝炎病史20余年，今晨突发呕血，色鲜红，量约为1500ml，急至医院就诊，查体：BP80/50mmHg，P106次/分，面色苍白，四肢末梢凉，脾于肋下缘5cm可触及，移动性浊音（+），腹壁可见静脉曲张，至医院后患者又呕血一次，量约300ml.患者出血原因最可能是
A. 食管胃底静脉曲张破裂
B. 脾亢进
C. 脾破裂
D. 胃溃疡出血
E. 肝内胆道出血

正确答案：A。食管胃底静脉曲张破裂

解析：中年患者乙肝病史20余年（可发展为肝炎后肝硬化），脾肋下缘5cm（脾大），移动浊音阳性（腹水），腹壁可见静脉曲张（门静脉高压严重），根据临床表现及病史，诊断为肝硬化。食管胃底静脉离门静脉主干和腔静脉最近，压力差最显著，受门静脉高压也最早最明显。突发呕血1500mL（量大），最可能的原因是食管胃底静脉曲张破裂（A对）。脾亢进（B错）主要表现为脾大、血细胞减少；脾破裂（C错）主要表现为内出血，两者均不会出现大呕血。胃溃疡出血（D错）不会出现脾大、腹壁静脉曲张。肝内胆道出血（E错）一般会有胆绞痛和黄疸表现。